在规定介质中，按要求缓慢非恒速释放药物的制剂称为
A. 被动靶向制剂
B. 缓释制剂
C. 控释制剂
D. 主动靶向制剂
E. 物理化学靶向制剂

正确答案：B。缓释制剂

解析：本题考查药物递送系统。缓释制剂（B对）指在规定释放介质中缓慢地非恒速释放药物；被动靶向制剂（A错）是指通过生理过程的自然吞噬使药物选择性地浓集于病变部位的靶向制剂；控释制剂（C错）指在规定的释放介质中缓慢地恒速释放药物；主动靶向制剂（D错）是用修饰的药物载体作为“导弹”，将药物定向地运送到靶区浓集发挥药效；物理化学靶向制剂（E错）是应用物理化学方法使靶向制剂在特定的部位发生药效的靶向制剂。